不含高能磷酸键的化合物是
A. 1，3-二磷酸甘油酸
B. 磷酸肌酸
C. 肌苷三磷酸
D. 磷酸烯醇式丙酮酸
E. 1，6-双磷酸果糖

正确答案：E。1，6-双磷酸果糖